强心苷治疗心房纤颤的机制主要是
A. 缩短心房有效不应期
B. 减慢房室传导
C. 抑制窦房结
D. 直接抑制心房纤颤
E. 延长心房不应期

正确答案：B。减慢房室传导

解析：强心苷对心肌电生理特性的影响既有对心肌细胞的直接作用，也有通过迷走神经的间接作用，其中迷走神经兴奋可减慢钙离子内流，使房室结除极减慢，传导速度减慢，减慢房室传导是强心苷治疗心房纤颤的主要机制（B对D错）。治疗量强心苷可兴奋迷走加速钾离子外流，使最大舒张电位加大，与阈电位间距加大，降低窦房结自律性（C错）。强心苷通过间接增加迷走神经活性加速钾离子外流而缩短心房有效不应期（E错），这是强心苷用于治疗心房扑动的主要机制（A错）。